翼突支柱将咀嚼压力传导至颅底是通过
A. 蝶骨翼突，上颌骨牙槽突的后端
B. 上颌骨腭突，腭骨垂直部
C. 颧牙槽嵴，上颌牙槽突的后端
D. 腭骨垂直部，颧牙槽嵴
E. 蝶骨翼突，上颌骨腭突

正确答案：A。蝶骨翼突，上颌骨牙槽突的后端

解析：本题考查翼突支柱。翼突支柱将咀嚼压力传导至颅底是通过蝶骨翼突，上颌骨牙槽突的后端（A对）。上颌骨与咀嚼功能关系密切，在承受咀嚼压力显著的部位，骨质增厚，以利于将咀嚼压力传导至颅底，由此形成尖牙支柱、翼突支柱、颧突支柱三对支柱，均下起上颌骨牙槽突，上达颅底。翼突支柱主要传导磨牙区的咀嚼压力，由蝶骨翼突，上颌骨牙槽突的后端相互连接而构成，将咀嚼压力传至颅底。颧突支柱主要传导第一磨牙区的咀嚼压力，通过上颌磨牙区的牙槽突，沿颧牙槽嵴传导。